下列哪一个药物是肝药酶的诱导剂
A. 氯霉素
B. 对氨基水杨酸
C. 异烟肼
D. 地西泮
E. 苯巴比妥

正确答案：E。苯巴比妥